药物的物理化学因素和患者的生理因素均影响药物吸收，属于影响药物吸收的物理化学因素有
A. 溶出速度
B. 脂溶性
C. 胃排空速度
D. 在胃肠道中的稳定性
E. 解离度

正确答案：A、B、D、E。溶出速度；脂溶性；在胃肠道中的稳定性；解离度

解析：本题考查影响药物吸收的物理化学因素。影响药物吸收的理化因素包括：1.脂溶性（B对）和解离度（E对）；2.溶出速度（A对）；3.药物在胃肠道中的稳定性（D对）。影响药物吸收的生理因素包括：1.胃肠液的成分和性质；2.胃肠道运动：包括胃肠道蠕动和胃排空（C错）；3.循环系统转运；4.食物对药物吸收的影响；5.胃肠道代谢的影响；6.疾病因素。